女，26岁。产前检查发现子宫肌瘤直径2cm。足月顺产后，阴道流血淋漓2月余，前日妇科检查子宫如孕10周，均匀增大。血hCG阳性。首选的治疗是
A. 全子宫切除+双附件切除
B. 全子宫切除
C. 抗癌药物治疗
D. 全子宫切除+化疗
E. 广泛性子宫切除

正确答案：C。抗癌药物治疗

解析：该患者产前检查发现子宫肌瘤直径2cm。足月顺产后，阴道流血淋漓2月余（妊娠滋养细胞肿瘤常见于葡萄胎排空后或流产、足月分娩、异位妊娠后出现阴道流血），妇科检查子宫如孕10周，均匀增大（妊娠滋养细胞肿瘤常于产后子宫未恢复到正常大小，而表现为子宫增大），血hCG阳性（妊娠滋养细胞肿瘤常在足月产后超过4周血hCG仍为阳性，或一度下降后又上升）。结合患者的临床表现，可诊断为妊娠滋养细胞肿瘤。妊娠滋养细胞肿瘤的治疗原则为采用以化疗为主、手术和放疗为辅的综合治疗，因此该患者首选的治疗是抗癌药物治疗（C对）。子宫切除适用于①无生育要求的无转移患者；②病灶大、耐药、穿孔出血者；③有生育要求但穿孔病灶不大者；④耐药病灶为单个及子宫外转移已控制者。 该患者仅26岁，尚处于生育期年龄，转移情况未知，暂无手术指征